下列各项，与哮喘发病密切相关的脏是
A. 心、肝、肾
B. 肝、脾、肾
C. 心、脾、肾
D. 肺、脾、心
E. 肺、脾、肾

正确答案：E。肺、脾、肾

解析：素体肺、脾、肾三脏不足，痰饮留伏，是支气管哮喘的主要内在因素。小儿肺脏娇嫩，脾常不足，肾常虚。气虚衰，治节无权，水津失于输布，凝液为痰；脾虚不能为胃行其津液，则积湿蒸痰，上储于肺；肾气虚衰，不能蒸化水液，使水湿上泛为痰，聚液成饮。痰之本水也，源于肾；痰之动湿也，主于脾；痰之末肺也，贮于肺。因此肺、脾、肾三脏虚衰，与痰饮留伏，有密切关系，可以导致本病的发生（E对）。